27岁已婚妇女，停经8周，下腹阵发性剧痛4小时伴阴道较多量流血。检查宫口开大2cm。本例最恰当的处置是
A. 给予止血药物
B. 肌注黄体酮
C. 肌注麦角新碱
D. 静滴缩宫素
E. 吸宫术

正确答案：E。吸宫术

解析：育龄女性患者，停经8周（早期流产发生在妊娠12周前），下腹阵发性剧痛伴阴道多量流血（难免流产时阴道流血量增多，阵发性下腹痛加剧），宫口开大2cm（难免流产时妇科检查宫口已开大），应诊断为早期难免流产，一旦确诊，应尽早使胚胎及胎盘组织完全排出，最恰当的处置是行负压吸宫术（E对）。晚期流产时，子宫较大，出血较多，可静滴缩宫素（D错）促进子宫收缩以引产。给予止血药物（A错）不能阻止流产性阴道出血。肌注黄体酮（B错）用于黄体功能不全引起的先兆流产患者。肌注麦角新碱（C错）用于流产后预防出血和治疗子宫收缩乏力或缩复不良导致的产后出血。